关于缓（控）释制剂的说法，正确的有
A. 缓（控）释制剂可以避免或减少血药浓度的峰谷现象
B. 可以用聚氯乙烯、聚乙烯等制成不溶性骨架片达到缓（控）释效果
C. 可以用羟丙甲纤维素等制成亲水性凝胶骨架片达到缓（控）释效果
D. 可以用巴西棕榈蜡等制成溶蚀性骨架片达到缓（控）释效果
E. 可以用微晶纤维素包衣制成渗透泵片达到缓（控）释效果

正确答案：A、B、C、D。缓（控）释制剂可以避免或减少血药浓度的峰谷现象；可以用聚氯乙烯、聚乙烯等制成不溶性骨架片达到缓（控）释效果；可以用羟丙甲纤维素等制成亲水性凝胶骨架片达到缓（控）释效果；可以用巴西棕榈蜡等制成溶蚀性骨架片达到缓（控）释效果

解析：本题考查缓（控）释制剂。缓、控释制剂与普通制剂相比，有以下优点：①减少服药次数，大大提高患者的顺应性；②释药徐缓，使血药浓度平稳，避免峰谷现象（A对），有利于降低药物的毒副作用，减少耐药性的发生；③缓、控释制剂可发挥药物的最佳治疗效果；④某些缓、控释制剂可以按照要求定时、定位释放药物，更加适合疾病的治疗。亲水性凝胶骨架材料可分为4类。①天然胶，如海藻酸盐、琼脂等；②纤维素衍生物，如甲基纤维素（MC）、羧甲基纤维素钠（CMC-Na）、羟丙甲纤维素（HPMC）（C对）、羟乙基纤维素（HEC）等；③非纤维素多糖类，如甲壳素、壳聚糖、卡波姆等；④高分子聚合物，如聚维酮（PVP）、聚乙烯醇（PVA）等。溶蚀性骨架材料是指疏水性强的脂肪类或蜡类物质，如动物脂肪、蜂蜡、巴西棕榈蜡、氢化植物油、硬脂醇、单硬脂酸甘油酯、硬脂酸丁酯等（D对）。不溶性骨架材料是指不溶于水或水溶性极小的高分子聚合物或无毒塑料等。常用的有乙基纤维素（EC）、聚乙烯、无毒聚氯乙烯、乙烯-醋酸乙烯共聚物、硅橡胶等（B对）。